“恬淡虚无，真气从之，精神内守，病安从来”，指出与防病关系密切的是
A. 精神刺激
B. 工作环境
C. 气候因素
D. 体制因素
E. 精神状态

正确答案：E。精神状态

解析：胸怀开朗乐观，心情舒畅，精神愉快，则人体气机调畅，气血和平，正气旺盛，对于预防疾病发生和发展，促进病情好转，具有重要意义（E对）。突然、强烈或持续的精神刺激，不仅可以直接伤及脏腑，引起气机紊乱，气血阴阳失调而发病，而且可使正气内虚，抗病能力下降，容易感受病邪而诱发疾病（A错）。工作环境、气候因素、体质因素体现的是三因制宜的原则，根据时令、，地域、患者等具体情况，制定适宜的方法（BCD错）。